关于促进扩散的错误表述是
A. 又称中介转运或易化扩散
B. 不需要细胞膜载体的帮助
C. 有饱和现象
D. 存在竞争抑制现象
E. 转运速度大大超过被动扩散

正确答案：B。不需要细胞膜载体的帮助

解析：本题考查药物的转运方式。促进扩散是指借助细胞膜载体（B错，为本题正确答案），由膜的高浓度一侧向低浓度一侧扩散或转运的过程；促进扩散又称中介转运或易化扩散（A对）；有饱和现象（C对）；存在竞争性抑制（D对）；促进扩散转运速度快于被动扩散（E对）。